青少年的营养需求特点是
A. 对能量的需要量与各营养素的供能比例是恒定的
B. 对能量、蛋白质的需要量与生长发育速率相一致
C. 每日摄入脂肪应占总能量的30%～35%
D. 每天需水量大于成人
E. 对各种维生素的需求量恒定

正确答案：B。对能量、蛋白质的需要量与生长发育速率相一致

解析：本题考查青少年的营养需求特点。青少年的营养需求特点是：1.青少年时期对各种营养素的需要量达到最大值，随着机体发育的不断成熟需要量逐渐有所下降（AE错）；2.生长发育中青少年的能量、蛋白质均处于正平衡状态，对能量、蛋白质的需要量与生长发育速率相一致（B对）；3.蛋白质的RNI男女分别为60～75g/d和55～60g/d， 脂肪的摄入量占总能最的20%～30%（C错），碳水化合物的摄入量占总能量的50%～65%；4.青少年每天需水量小于成人（D错）。